传染病爆发、流行时，县级以上地方人民政府应当
A. 宣布疫区
B. 限制或者停止集市、集会
C. 停业、停工、停课
D. 临时征用房屋、交通工具
E. 立即组织力量防治，切断传播途径

正确答案：E。立即组织力量防治，切断传播途径

解析：当传染病暴发、流行时，县级以上地方人民政府应当立即组织力量，按照预防、控制预案进行防治，切断传染病的传播途径（E对）。限制或者停止集市、集会（B错）；停工、停业、停课（C错）均须在必要时，报经上一级人民政府决定，才可以采取。当甲类、乙类传染病暴发、流行时，且县级以上地方人民政府报经上一级人民政府决定，才可以宣布疫区（A错）（P70）。传染病暴发、流行时，可根据传染病疫情控制的需要，在本行政区域内调用储备物资，临时征用房屋、交通工具（D错），不属于传染病暴发流行时的紧急措施（P71）。